高血压伴有心绞痛的病人宜选用
A. 卡托普利
B. 硝苯地平
C. 利血平
D. 氢氯噻嗪
E. 普萘洛尔

正确答案：E。普萘洛尔

解析：普萘洛尔（又称心得安），为非选择性β受体阻断剂，用于各种程度的原发性高血压。对心输出量及肾素活性偏高者疗效较好，高血压伴有心绞痛、偏头痛、焦虑症等选用β受体阻断剂较为合适。掌握“抗高血压药”知识点。